女，32岁，妊娠40周，腹痛8小时，宫口开3cm，头先露，s0，胎儿心率低于110次，阴道突然流液，可摸到条索状，此时处理
A. 调转体位观察
B. 上抬胎头剖宫产
C. 上抬胎头观察
D. 上抬胎头静滴缩宫素
E. 上抬胎头还纳条索状

正确答案：B。上抬胎头剖宫产

解析：患者女，32岁，妊娠40周，腹痛8小时，宫口开3cm（第一产程潜伏期），头先露，s0，胎儿心率低于110次（正常胎心率基线110～160／分，该患者胎儿低于110次，为胎儿心动过缓，提示胎儿缺氧），阴道突然流液，可摸到条索状，摸到条索样物，考虑脐带脱垂，由于宫口未开全，结合患者的表现，应行上抬胎头剖宫产（B对）。